《药品召回管理办法》规定，“使用该药品可能引起严重健康危害的”，要采取
A. 48小时内召回
B. 72小时内召回
C. 一级召回
D. 二级召回
E. 三级召回

正确答案：C。一级召回

解析：本题考查的是药品召回分级。《药品召回管理办法》规定，“使用该药品可能引起严重健康危害的”，要采取一级召回（C对）。药品召回分级：根据药品安全隐患的严重程度，药品召回分为三级：对使用该药品可能引起严重健康危害的实施一级召回；对使用该药品可能引起暂时的或者可逆的健康危害的实施二级召回（D错）；对使用该药品一般不会引起健康危害，但由于其他原因需要收回的实施三级召回（E错）。